动作电位到达运动神经末梢时引起
A. K⁺内流
B. Cl⁻内流
C. Na⁺内流
D. K⁺外流
E. Ca²⁺内流

正确答案：E。Ca²⁺内流